腮腺导管的体表投影为
A. 外耳孔至鼻翼与口角之间中点连线的中1/3段
B. 耳屏至鼻翼与口角之间中点连线的中1/3段
C. 耳垂至鼻翼与口角之间中点连线的中1/3段
D. 外耳孔至鼻翼连线的中1/3段
E. 耳垂至鼻翼连线的中1/3段

正确答案：C。耳垂至鼻翼与口角之间中点连线的中1/3段

解析：腮腺导管的体表投影：为耳垂至鼻翼与口角之间中点连线的中1/3处。掌握“腮腺咬肌区、腮腺与面神经解剖关系”知识点。